阿昔洛韦可治疗的疾病是
A. 疱疹病毒感染
B. 流感病毒感染
C. 麻疹病毒感染
D. 乙型脑炎病毒感染
E. 人类免疫缺陷病毒（HIV）感染

正确答案：A。疱疹病毒感染

解析：本题考查阿昔洛韦。阿昔洛韦可治疗的疾病是疱疹病毒感染（A对）。阿昔洛韦是治疗HSV感染的首选药物。流感病毒感染（B错）可用治疗药物有金刚烷胺、金刚乙胺、恩夫韦肽、利巴韦林等。麻疹病毒感染（C错）临床上尚无特效抗病毒药，主要为对症治疗，加强护理，预防和治疗并发症。乙型脑炎病毒（D错）可用治疗药物有利巴韦林、干扰素。人类免疫缺陷病毒（HIV）感染（E错）可用治疗药物有齐多夫定、拉米夫定、恩曲他滨等。